风寒感冒兼胸脘痞闷，食少纳呆，脉濡者，治疗应首选
A. 荆防败毒散
B. 香苏散
C. 杏苏散
D. 羌活胜湿汤
E. 三仁汤

正确答案：D。羌活胜湿汤

解析：兼症见胸脘痞闷，食少纳呆，脉濡者，提示有湿象，本题考察风寒感冒兼表湿的选方，应用羌活胜湿汤祛风除湿（D对）。荆防败毒散是感冒风寒束表的主方（A错）。香苏散主治是气郁不舒之外感风寒，症见恶寒身热，头痛无汗，胸脘痞闷，不思饮食，舌苔薄白，脉浮（B错）。杏苏散主治是外感凉燥证，症见恶寒无汗，头微痛，咳嗽痰稀，鼻塞咽干，苔白脉弦（C错）。三仁汤主治湿热病之湿重于热，头痛恶寒，身重疼痛，肢体倦怠，面色淡黄，胸闷不饥，午后身热，苔白不渴，脉弦细而滑（E错）。